符合大叶性肺炎炎性特征的是
A. 以浆液渗出为主
B. 以纤维素渗出为主
C. 以淋巴细胞渗出为主
D. 以中性粒细胞渗出为主
E. 以嗜酸性粒细胞渗出为主

正确答案：B。以纤维素渗出为主

解析：大叶性肺炎的主要病理变化为纤维素性渗出（B对）。以浆液渗出为主（A错）的炎性改变为浆液性炎的病理特征。以淋巴细胞渗出为主（C错）是慢性炎症的病理特征。以中性粒细胞渗出为主（D错）的是化脓性炎，小叶性肺炎属于此类。以嗜酸性粒细胞渗出为主（E错）多见于寄生虫及IgE介导的炎症反应。